通过插入DNA双螺旋链发挥作用的药物是
A. 盐酸左旋咪唑
B. 吡喹酮
C. 乙胺嘧啶
D. 磷酸氯喹
E. 甲硝唑

正确答案：D。磷酸氯喹

解析：本题考查磷酸氯喹。通过插入DNA双螺旋链发挥作用的药物是磷酸氯喹（D对）。磷酸氯喹的作用机制是，它能进入疟原虫体，其分子插入DNA双螺旋链之间，形成稳定的复合物，从而影响DNA复制、RNA的转录和蛋白质的合成。盐酸左旋咪唑（A错）为广谱驱肠虫药。吡喹酮（B错）为抗血吸虫病药。乙胺嘧啶（C错）能抑制疟原虫的二氢叶酸还原酶，使其叶酸代谢受阻，从而影响疟原虫的核酸合成，使其生长繁殖受到抑制。甲硝唑（E错）为抗阿米巴病药。